临床出现自汗多尿，是气的哪一种功能减退的表现
A. 推动与调控作用
B. 温煦与凉润作用
C. 防御作用
D. 固摄作用
E. 中介作用

正确答案：D。固摄作用

解析：气具有固摄汗液、尿液、唾液、胃液、肠液，控制其分泌量、排泄量，使其有度而规律地排泄，防止其过多排出及无故流失所以临床上出现自汗多尿是气固摄作用功能的减退（D对）。气的推动作用是指阳气的激发、兴奋、促进等作用；气的调控作用，是指阴气的减缓、抑制、宁静等作用（A错）。气的温煦作用，是指阳气的促进产热，消除寒冷，是人体温暖的作用（B错）。气的防御作用，气既能护卫机表，防御外邪入侵，同时也可以祛除侵入人体内的病邪（C错）。气的中介作用，主要指气能感应传导信息以维系机体的整体联系（E错）。